下颌骨髁突颈部骨折与暴力造成的关节盘急性前脱位区别点正确的是
A. 单侧髁突颈部骨折，中线偏向患侧
B. 双侧髁突颈部骨折前牙呈开（牙合）状态
C. 髁突颈部有压痛、皮下血肿
D. X线片示髁突颈部有骨折线
E. 以上区别点均正确

正确答案：E。以上区别点均正确

解析：本题考查下颌骨髁突颈部骨折与暴力造成的关节盘急性前脱位的区别。下颌骨髁突单侧骨折时，患侧下颌向外侧及后方移位，致使中线偏向患侧（A对）。双侧髁突颈部骨折者，下颌不能作前伸运动，由于升颌肌群的牵拉，下颌支向后上移位，导致后牙早接触，前牙开（牙合）更明显（B对）。下颌骨髁突骨折时耳前区肿胀、疼痛，骨折髁突的外极常有压痛（C对）。X线片可见髁突颈部有骨折线（D对）。（ABCD均对，故E为本题的正确答案）。